生产条件下毒物进入人体的主要途径是
A. 皮肤和消化道
B. 消化道和呼吸道
C. 消化道和黏膜
D. 呼吸道和皮肤
E. 手-口途径

正确答案：D。呼吸道和皮肤

解析：本题考查生产性毒物进入人体的主要途径。生产性毒物主要经呼吸道吸收进入人体；亦可经皮肤（D对ABCE错）和消化道吸收。由于肺泡结构特点，导致呈气体、蒸气和气溶胶状态的毒物均可经呼吸道吸收进入人体而导致中毒；皮肤对外来化合物具有屏障作用，但确有不少外来化合物可经皮肤吸收，如芳香族氨基和硝基化合物、有机磷酸酯类化合物、氨基甲酸酯类化合物、金属有机化合物等；毒物经消化道摄入所致的职业中毒甚为少见，常见于事故性误服。因此，毒物常见的进入人体的途径为呼吸道和皮肤。